女，30岁，持续发热10天。体检：精神萎靡，反应淡漠，体温39.5℃，心率70次/分，肝肋下未触及，脾肋下2cm。化验：WBC1.4×l0⁹/L，N60%，L40%，肥达氏反应01：80（+），H1：160（+），ALT180U/L，总胆红素22.2umol/L。该病例最可能的诊断是
A. 急性黄疸型肝炎
B. 钩端螺旋体病
C. 伤寒
D. 斑疹伤寒
E. G-杆菌败血症

正确答案：C。伤寒

解析：患者持续发热，表情淡漠，腹胀便秘，肝脾肿大，相对缓脉（伤寒特征性的临床表现），白细胞1.4×10⁹/L（成人正常参考值4～10×10⁹/L）减少，肥达试验阳性，故诊断伤寒可能性大（C对）。急性黄疸型肝炎（P28）（A错）应有尿色加深、黄疸等典型表现。钩体病（P253）（B错）常表现为发热、酸痛、全身软、眼红、腿痛、淋巴结肿大等。斑疹伤寒（P134）（D错）以急性起病、稽留型高热、剧烈头痛皮疹与中枢神经系统症状为特征。败血症（P225）（E错）常表现为寒战高热，白细胞增高等中毒症状。